某工人从事蓄电池制造工作5年，近来出现头昏、头痛、全身无力、记忆力减退、睡眠障碍、多梦等症状，并出现突发性腹部绞痛，牙齿边缘形成蓝黑色的线。该工人最可能的诊断是
A. 慢性汞中毒
B. 慢性铅中毒
C. 正已烷中毒
D. 苯中毒
E. 苯胺中毒

正确答案：B。慢性铅中毒